在传播材料预试验中，听取有关领导对该材料的修改意见属于
A. 可读性试验
B. 重点人群调查
C. 把关人调查
D. 问卷调查
E. 以上都不是

正确答案：C。把关人调查